咀嚼运动的基本形式
A. 开闭口，侧方咬合，前伸后退咬合
B. 单侧，双侧，双侧交替
C. 切割，捣碎，磨细
D. 边缘，叩齿，咀嚼
E. 切割，撕裂，捣碎

正确答案：C。切割，捣碎，磨细

解析：本题考查咀嚼运动的过程。咀嚼运动的基本形式为切割，捣碎，磨细（C对）。咀嚼运动是下颌复杂而有规律的运动，分析咀嚼的过程可以将咀嚼运动分为前牙切割和后牙的捣碎、磨细三个基本动作。在咀嚼的过程中，三个动作连续顺畅、重复进行，完成整个进食过程。